21三体综合征标准型
A. 46，XY（或XX），-14，+t（14q21q）
B. 47，XY（或XX），+21
C. 46，XY（或XX）/47，XY（或XX）+21
D. 46，XY（或XX），-21，+t（21q21q）
E. 46，XY（或XX），-21，+t（21q22q）

正确答案：B。47，XY（或XX），+21

解析：本题为记忆题。三体综合征标准型（B对）的核型为47，XY（或XX），+21，46，XY（或XX）/47，XY（或XX）+21（C错）是21三体综合征嵌合型的核型，46，XY（或XX），-14，+t（14q21q）是21三体综合征易位型（A错）。